患者，男，54岁，因医院获得性肺炎给予哌拉西林-他唑巴坦治疗。应用7天后出现严重腹泻，诊断为伪膜性肠炎。宜选用的药物是
A. 口服甲硝唑
B. 肌注肾上腺素
C. 静注地塞米松
D. 口服维生素B₆
E. 肌注维生素K₁

正确答案：A。口服甲硝唑

解析：本题考查伪膜性肠炎的药物治疗。对于长期使用广谱抗生素导致的伪膜性肠炎，可以使用甲硝唑（A对）进行治疗。若甲硝唑无效，可使用万古霉素。